滑脉所主的病症有
A. 痰饮
B. 瘀血
C. 食滞
D. 实热
E. 痞块

正确答案：A、C、D。痰饮；食滞；实热

解析：本题考查的是滑脉与主病。滑脉所主的病症有痰饮（A对）、食滞（C对）与实热（D对）。滑脉与主病：［脉象］“往来流利，如盘走珠”，指下有一种圆滑感。［主病］痰饮、食滞、实热等。平人脉滑而冲和，是营卫充实之象。妇人妊娠亦常见滑象，是血气充盛而和调的表现。瘀血（B错）为结脉的主病。结脉：脉来缓慢而有不规则的间歇。主阴盛气结、寒痰瘀血。寒痰瘀血，气结不行，脉气阻滞，故也见结脉。痞块（E错）为牢脉的主病。牢脉：脉来实大弦长，浮取、中取均不应，推沉取始得，坚牢不移。多见于阴寒积聚的病证，如癥瘕、痞块、疝气等。